选择固定桥基牙时，下列哪一项是错误的
A. 基牙的固位能力
B. 基牙必须是活髓牙
C. 基牙的松动度
D. 基牙的共同就位道
E. 基牙的支持能力

正确答案：B。基牙必须是活髓牙

解析：基牙选择理想情况是活髓牙，但若深龋已经引起牙髓炎症，或死髓牙，牙髓已经过牙髓病治疗，根管充填完善，根尖周无感染，牙周组织比较完整，牙体组织能承受固定桥咬合力的无髓牙也可选作桥基牙。掌握“固定桥的生理基础”知识点。